原核生物多肽链翻译阶段有释放因子RF识别结合终止密码，释放因子诱导以下作用中错误的是
A. 转肽酶发挥肽链水解酶作用
B. 促进核糖体上tRNA脱落
C. 促进合成肽链折叠成空间构象
D. 促进合成肽链脱落
E. mRNA与核糖体分离

正确答案：C。促进合成肽链折叠成空间构象

解析：释放因子：原核生物中有4种，在真核生物中只有1种。作用是与终止密码子结合终止肽链的合成并使肽链从核糖体上释放出来。功能：一是识别终止密码，如RF-1特异识别UAA、UAG；而RF-2可识别UAA、UGA。二是诱导转肽酶改变为酯酶活性，相当于催化肽酰基转移到水分子-OH上，使肽链从核蛋白体上释放。掌握“蛋白质的生物合成”知识点。